第4-5胸椎受损伤，可累及脊髓的节段是
A. 颈段
B. 胸段
C. 腰段
D. 骶段
E. 骶、尾段

正确答案：B。胸段

解析：根据脊髓节段与椎骨的对应关系，中胸节段（B对）对应第4-5胸椎。